主动脉弓从右向左发出的第一个分支是
A. 左锁骨下动脉
B. 左颈总动脉
C. 右锁骨下动脉
D. 头臂干
E. 右颈总动脉

正确答案：D。头臂干

解析：从主动脉弓上发出的分支由右向左分别为头臂干、左颈总动脉和左锁骨下动脉。头臂干（D对）为主动脉弓从右向左发出的第一个分支。